下列哪种疾病触诊语颤消失
A. 肺炎性浸润
B. 肺梗死
C. 肺结核空洞
D. 肺纤维化
E. 支气管阻塞

正确答案：E。支气管阻塞

解析：语音震颤的强弱主要取决于气管、支气管是否通畅，胸壁传导是否良好而定。触诊语颤消失的是支气管阻塞（E对）。肺炎性浸润（A错）、肺梗死（B错）、肺结核空洞（C错）、肺纤维化（D错）触诊时语颤增强。